输血的适应证中，不包括
A. 脱水及代谢性酸中毒
B. 贫血
C. 出血
D. 重症感染
E. 凝血机制障碍

正确答案：A。脱水及代谢性酸中毒

解析：外科输血的目的有两个方面，一是纠正低血容量，二是纠正血液成分的缺乏，外科输血的适应证都是由此而来。输血的适应症：1.急性大量出血（C对）2.贫血（B对）或低蛋白血症3.重症感染（D对）4.凝血异常（E对）（A错，为本题正确答案）。